根据《关于完善基本医疗保险定点医药机构协议管理的指导意见》，关于基本医点医药机构法管理的说法，正确的是
A. 加强定点医疗机构和定点零售药店的资格审查，由社会保险经办机构与通过前置审批的医药机构直接签订定点服务协议
B. 取消定点医疗机构和定点零售药店的资格审由社会保险经办机构与符合件的医药机构签订定点服务协议
C. 参保人员只能选择一家定点医疗机购药
D. 对未列入“医保目录”的基本药物适当加大自付比例

正确答案：B。取消定点医疗机构和定点零售药店的资格审由社会保险经办机构与符合件的医药机构签订定点服务协议

解析：本题考查的是定点医药机构资格审查和协议管理。根据《关于完善基本医疗保险定点医药机构协议管理的指导意见》，关于基本医点医药机构法管理的说法，正确的是取消定点医疗机构和定点零售药店的资格审由社会保险经办机构与符合件的医药机构签订定点服务协议（B对）。定点医药机构资格审查和协议管理：基本医疗保险制度建立以来，我国实行“基本医疗保险定点医疗机构资格审查”和“基本医疗保险定点零售药店资格审查”制度，在此基础上，社会保险经办机构与通过审查的医疗机构和零售药店（以下简称医药机构）签订定点服务协议。2015年10月，《国务院关于第一批取消62项中央指定地方实施行政审批事项的决定》（国发〔2015〕57号）要求到2015年底前，取消社会保险行政部门实施的两定资格审查，完善经办机构与医药机构的协议管理，提高管理服务水平和基金使用效率，更好地满足参保人员的基本医疗需求。据此，人力资源社会保障部出台《关于完善基本医疗保险定点医药机构协议管理的指导意见》（人社部发〔2015〕98号），为简政放权、强化监管和优化服务，将定点医药机构确认由行政部门进行两定资格审查后再由经办机构签订定点服务协议的“两步走”，转变为仅由经办机构与符合条件的医药机构签订服务协议的“一步走”，行政部门不再进行前置审批。